青霉素主要用于治疗
A. 脑膜炎奈瑟球菌感染
B. 革兰阳性杆菌感染
C. 支原体感染
D. 螺旋体感染
E. 革兰氏阴性杆菌感染

正确答案：A、B、D。脑膜炎奈瑟球菌感染；革兰阳性杆菌感染；螺旋体感染

解析：本题考查青霉素的适应证。青霉素可用于：大多数G⁺球菌、G⁺杆菌（B对）、G⁻球菌如脑膜炎奈瑟菌（A对）、少数G⁻杆菌、螺旋体（D对）、放线杆菌等。对大多数G⁻杆菌（E错）、支原体（C错）作用较弱。